血浆半衰期较短的治疗阴茎勃起功能障碍的5型磷酸二磷脂抑制剂的是
A. 他达拉非
B. 甲睾酮
C. 西地那非
D. 丙酸睾酮
E. 非那雄胺

正确答案：C。西地那非

解析：本题考查治疗男性勃起功能障碍药物。西地那非（C对）为5型磷酸二磷脂抑制剂，作用时间短。他达拉非（A错）为5型磷酸二磷脂抑制剂，作用持续时间长。甲睾酮（B错）、丙酸睾酮（D错）均为雄激素。非那雄胺（E错）为5α还原酶抑制剂，用于治疗和控制良性前列腺增生症以及预防泌尿系统事件。